健康促进的目标人群涉及
A. 残疾人
B. 孕产妇
C. 青少年
D. 中老年
E. 整个人群

正确答案：E。整个人群